普萘洛尔降低血压的作用机制包括
A. 阻断心脏β₁受体
B. 减少肾素分泌
C. 阻断中枢β受体
D. 阻断突触前膜β₂受体
E. 减少前列环素（PGI₂）合成

正确答案：A、B、C、D。阻断心脏β₁受体；减少肾素分泌；阻断中枢β受体；阻断突触前膜β₂受体

解析：本题考查普萘洛尔。β受体阻断药的降压作用机制：①阻断心脏β₁受体（A对），降低心排血量。②阻断肾小球旁器的β₁受体，减少肾素分泌（B对），从而抑制肾素-血管紧张素系统活性。但具有较强内在拟交感活性的药物在降压时并不影响肾素分泌。③β受体阻断药能通过血脑屏障进入中枢，阻断中枢β受体（C对），使外周交感神经活性降低。但索他洛尔、阿替洛尔等难以通过血脑屏障却仍有确切降压作用。④阻断外周去甲肾上腺素能神经末梢突触前膜β₂受体（D对），抑制正反馈调节作用，减少去甲肾上腺素的释放。⑤促进前列环素的生成（E错）。